表面连接上某种抗体或抗原的脂质体是
A. 长循环脂质体
B. 免疫脂质体
C. 半乳糖修饰的脂质体
D. 甘露糖修饰的脂质体
E. 热敏感脂质体

正确答案：B。免疫脂质体

解析：本题考查脂质体。免疫脂质体（B对）：脂质体表面联接抗体，对靶细胞进行识别，提高脂质体的靶向性。长循环脂质体（A错）：PEG修饰可增加脂质体的柔顺性和亲水性，从而降低与单核巨噬细胞的亲和力，延长循环时间，称为长循环脂质体。长循环脂质体有利于对肝脾以外的组织或器官的靶向作用。同时，将抗体或配体结合在PEG的末端，既可保持长循环，又可保持对靶点的识别。半乳糖修饰的脂质体（C错）、甘露糖修饰的脂质体（D错）属于特殊性能脂质体中的多糖被复脂质体，结合了天然或人工合成的糖脂的脂质体。热敏脂质体（E错）：利用在相变温度时，脂质体的类脂质双分子层膜从胶态过渡到液晶态，脂质膜的通透性增加，药物释放速度增大的原理制成热敏脂质体。